下列哪项缺乏不会引起牙釉质发育不全
A. 维生素A
B. 维生素C
C. 维生素D
D. 维生素E
E. 钙和磷

正确答案：D。维生素E

解析：本题考查牙釉质发育不全的病因。维生素E（D错，为本题正确答案）是最主要的抗氧化剂之一，还可抑制眼睛晶状体内的过氧化脂反应，使末梢血管扩张，改善血液循环，预防近视的发生和发展。维生素A（A对）、维生素C（B对）、维生素D（C对）以及钙磷（E对）的缺乏，均可影响成釉细胞分泌釉质基质和矿化，引起牙釉质发育不全。其中维生素A缺乏，对上皮组织的影响很明显，而釉质为上皮组织的成釉细胞所形成。维生素C缺乏时，成釉细胞不能分化成高柱状细胞而蜕变成扁平，使釉质发育不全。维生素D缺乏时，钙盐在骨和牙组织中沉积迟缓，甚至停止，影响釉质正常的矿化及形成。